女性，62岁。冬季房屋内煤火取暖，次日晨被发现昏迷。查体：呼吸20次/分，心率97次/分，昏迷，口唇呈樱桃红色。最适宜的治疗是
A. 静脉用抗生素
B. 静脉用呼吸兴奋剂
C. 静脉用甘露醇
D. 高压氧治疗
E. 机械通气

正确答案：D。高压氧治疗